脑血栓的常见病因
A. 糖尿病
B. 脑脂肪瘤
C. 动脉粥样硬化
D. 动脉瘤
E. 风湿性心脏瓣膜病

正确答案：C。动脉粥样硬化

解析：本题考查脑血栓的病因。脑血栓的常见病因为动脉粥样硬化（C对）。脑血栓形成是缺血性脑血管病的一种，多见于中老年人，无明显性别差异，它是由于脑血管壁本身的病变引起的。脑血栓形成最常见的病因是动脉硬化。